混合瘤的好发部位依次是
A. 腭腺、腮腺、舌下腺
B. 下颌下腺、舌下腺、腭腺
C. 腮腺、舌下腺、下颌下腺
D. 舌下腺、下颌下腺、腮腺
E. 腮腺、下颌下腺、舌下腺

正确答案：E。腮腺、下颌下腺、舌下腺

解析：在大唾液腺中，多形性腺瘤最常见于腮腺，其次为下颌下腺，舌下腺极少见。发生于小唾液腺者，以腭部为最常见。掌握“多形性腺瘤”知识点。